29岁初产妇，妊娠39周。于凌晨4时临产，10时宫口开大3cm；20时宫口开大7cm。应诊断为
A. 潜伏期延长
B. 活跃期延长
C. 活跃期停滞
D. 第二产程停滞
E. 第二产程延长

正确答案：B。活跃期延长

解析：该初产妇10时宫口开大3cm，已进入活跃期。20时宫口开大7cm，宫口扩张＜0.5cm/h，考虑活跃期延长（B对）。潜伏期延长（P208）为潜伏期超过16h（A错）。活跃期停滞（P209）为进入活跃期后，宫颈口不再扩张超过4小时（C错）。第二产程延长（P209）为初产妇第二产程＞2小时，经产妇＞1h（E错）。第二产程停滞（D错）八版妇产科学教材未明确说明。